下列可引起中性粒细胞病理性增多的是
A. 麻疹
B. 急性溶血
C. 恶性组织细胞病
D. 系统性红斑狼疮
E. 脾功能亢进

正确答案：B。急性溶血

解析：下列可引起中性粒细胞病理性增多的是急性溶血（B对），急性溶血时严重组织损伤引起细胞免疫增强，导致中性粒细胞大量增多。麻疹（A错）、恶性组织细胞病（C错）、系统性红斑狼疮（D错）、脾功能亢进（E错）中性粒细胞均减少。